组成大柴胡汤的药物中有
A. 枳实、半夏
B. 黄连、大枣
C. 白术、当归
D. 香附、柴胡
E. 枳壳、陈皮

正确答案：A。枳实、半夏

解析：大柴胡汤用大黄，枳实芩夏白芍将，煎加姜枣表兼里，妙法内攻并外攘（A对）。大柴胡汤的功用为和解少阳，内泻热结，主治少阳阳明合病。往来寒热，胸胁苦满，呕不止，郁郁微烦，心下痞硬，或心下急痛，大便不解或协热下利，舌苔黄，脉弦数有力。